下列有关预防颞下颌关节紊乱病的措施中，除外
A. 避免关节区受到寒冷刺激
B. 纠正不良咀嚼习惯
C. 避免长时间大张口
D. 保持乐观情绪
E. 颞下颌关节可过度运动

正确答案：E。颞下颌关节可过度运动

解析：本题考查预防颞下颌关节紊乱病的措施。颞下颌关节紊乱病一般认为与以下因素有关：1.心理社会因素，患者常有情绪焦虑等不良情绪；2.（牙合）因素，包括牙尖早接触，垂直距离过低等；3.免疫因素；4.关节负荷过重，包括夜磨牙，紧咬牙，长时间吃硬物等不良咀嚼习惯；5.关节解剖因素；6.其他因素，如突然关节受到寒冷刺激，不良姿势等。预防颞下颌关节紊乱病应从避免病因做起，保持乐观情绪（D对），避免关节区受到寒冷刺激 （A对），纠正不良咀嚼习惯（B对），如咀嚼硬物、大张口吃苹果等，避免长时间大张口（C对）及避免颞下颌关节过度运动（E错，为本题的正确答案）等。